胆汁中与消化有关最重要的物质是
A. 消化酶
B. 胆盐
C. 卵磷脂
D. 胆色素
E. 脂肪酸

正确答案：B。胆盐